男，45岁。头痛、视物模糊3月余，查体：视力明显减退，视野缺损。查血T₃，T₄，TSH降低，血ACTH、皮质醇降低。进—步应做的检查是
A. 肾上腺CT
B. 脑血管造影
C. 甲状腺ECT
D. 垂体MRI
E. 胸部X线片

正确答案：D。垂体MRI

解析：中年男性患者，头痛，视物模糊、视力明显减退、视野缺损（视神经压迫症状）。血T₃，T₄，TSH降低，血ACTH、皮质醇降低（垂体功能减退的一系列表现）。最可能的诊断是垂体肿瘤。进—步应做的检查是垂体MRI（D对）。MRI不仅可发现直径3mm的微腺瘤，而且可显示下丘脑结构，对于临床判断某些病变有肯定价值。